就病例对照研究而言，下述哪项是错误的
A. 属于描述性研究
B. 设立比较组
C. 研究方向由果及因
D. 特别适合对罕见病的研究
E. 省时省力

正确答案：A。属于描述性研究